职业性有害因素对妇女产生的异常妊娠结局不包括
A. 流产
B. 早产
C. 痛经
D. 死产
E. 低体重儿

正确答案：C。痛经